老年男性，64岁，因下颌牙列缺损来修复科就诊。查可见：下颌765│467缺失，其余牙齿二度松动，口底较浅，其距下颌前牙龈缘为0.5cm，则在设计下颌可摘局部义齿大连接体时应该选用
A. 舌杆
B. 舌板
C. 对半卡环
D. 联合卡环
E. 连续卡环

正确答案：B。舌板

解析：舌板：舌板是金属铸成的舌基托，为舌杆上缘向上延伸，覆盖至下前牙的舌隆突区。用于口底浅，舌侧软组织附着高（口底到龈缘的距离在7mm以下）。掌握“局部义齿连接体”知识点。